关于苯二氮（艹卓）类的叙述，哪项是错误的
A. 是最常用的镇静催眠药
B. 治疗焦虑症有效
C. 可用于小儿高热惊厥
D. 可用于心脏电复律前给药
E. 长期用药不产生耐受性和依赖性

正确答案：E。长期用药不产生耐受性和依赖性

解析：苯二氮（艹卓）类具有镇静、抗焦虑、肌肉松弛、抗惊厥作用。可用于小儿高热惊厥。掌握“苯二氮?类”知识点。